风疹的临床表现是
A. 潜伏期5～7天
B. 高热
C. 热退后全身出疹
D. 颈后枕后淋巴结肿痛
E. 出疹后脱皮

正确答案：D。颈后枕后淋巴结肿痛

解析：风疹的特征性表现是全身症状轻（B错），耳后、颈后枕后淋巴结肿痛（D对），皮疹特点是斑丘疹、退疹后无色素沉着及脱屑（E错），与发热的关系是发热半天至一天后出疹（C错）。